副交感神经中
A. 上泌涎核→耳神经节→腮腺
B. 下泌涎核→下颌下神经节→下颌下腺、舌下腺
C. 下泌涎核→翼腭神经节→泪腺
D. 以上都对
E. 以上都不对

正确答案：E。以上都不对

解析：副交感神经部分节前纤维经鼓索，加入舌神经，至下颌下神经节交换神经元，节后纤维分布于下颌下腺和舌下腺，选项中无正确答案（E对）。